下列乳牙髓腔形态特点说法中，正确的是
A. 乳磨牙通常有3个根管
B. 乳磨牙通常有4个根管
C. 乳磨牙通常有2个根管
D. 下颌第二乳磨牙一般为4个根管
E. 上颌乳磨牙一般为2个根管

正确答案：A。乳磨牙通常有3个根管

解析：乳磨牙髓室较大，通常均有3个根管，上颌乳磨牙有2个颊侧根管，1个舌侧根管；下颌乳磨牙有两个近中根管，1个远中根管。下颌第二乳磨牙有时可出现4个根管，其分布为近中2个根管，远中2个根管。掌握“恒磨牙髓腔形态及乳恒牙髓腔临床意义”知识点。